以下有关工业氟中毒的描述中，正确的是
A. 一般持续10～20年
B. 摄入氟每日可达20～80mg
C. 骨中的氟可导致骨硬化症
D. 多见从事冰晶石或矾土作业的工人
E. 以上说法均正确

正确答案：E。以上说法均正确

解析：工业氟中毒主要是指从事冰晶石或矾土作业的工人，通过吸入、食用或饮水摄入的氟，每日可达20～80mg，这种状况持续10～20年，骨中的氟可导致骨硬化症。掌握“氟毒性及氟牙症”知识点。